医疗机构在作出受理决定之日起多长时间之内需要递交鉴定材料并通知申请人
A. 3日
B. 5日
C. 7日
D. 14日
E. 21日

正确答案：B。5日

解析：需要进行医疗事故技术鉴定的，卫生行政部门应当自作出受理决定之日起5日内将有关材料交由负责医疗事故技术鉴定工作的医学会组织鉴定并书面通知申请人。掌握“医疗事故行政处理、监督与法律责任”知识点。